患儿，4岁。有久泻病史。近3月来，面黄唇淡，发黄稀疏，食欲不振，体倦乏力，头晕目眩，睡眠不安，舌淡红，脉细弱。查血常规：血红蛋白95g/L。其治法是
A. 健运脾胃，益气养血
B. 补脾养心，益气生血
C. 滋养肝肾，益精生血
D. 温补脾肾，益阴养血
E. 健脾养血，补肾益精

正确答案：B。补脾养心，益气生血

解析：该题主要考查小儿缺铁性贫血的辩证以及治法。缺铁性贫血是由于体内铁缺乏致使血红蛋白合成减少而引起的一种小细胞低色素性贫血。患儿，4岁。有久泻病史。近3月来，面黄唇淡，发黄稀疏，食欲不振，体倦乏力，头晕目 眩，睡眠不安，舌淡红，脉细弱。查血常规：血红蛋白95g/L。可判断为缺铁性贫血心脾两虚，治法补脾养心，益气生血（B对）。健运脾胃，益气养血为缺铁性贫血脾胃虚弱治法，证候长期纳食不振，神疲乏力，形体消瘦，面色苍黄，唇淡甲白，大便不调，舌淡苔白，脉细无力，指纹淡红（A错）。滋养肝肾，益精生血为缺铁性贫血肝肾阴虚治法，证候面色皮肤豁膜苍白，爪甲色白易脆，发育迟缓，头晕目涩，两颧潮红，潮热盗汗，毛发枯黄，四肢震颤抽动，舌红，苔少或光剥，脉弦数或细数（C错）。温补脾肾，益阴养血为缺铁性贫血脾肾阳虚治法，证候面色眺白，唇舌爪甲苍白，精神萎靡不振，纳谷不馨，或有大便塘泄，发育迟缓，毛发稀疏，四肢不温，舌淡苔白，脉沉细无力，指纹淡（D错）。缺铁性贫血无健脾养血，补肾益精治法（E错）。